比较两药疗效时，下列可作单侧检验的是
A. 己知A药与B药均有效
B. 不知A药好还是B药好
C. 己知A药与B药差不多好
D. 己知A药不会优于B药
E. 不知A药与B药是否有效

正确答案：D。己知A药不会优于B药